6-磷酸果糖激酶-1的变构激活剂是
A. 6-双磷酸果糖
B. ATP
C. 2，6-二磷酸果糖
D. GTP
E. 柠檬酸

正确答案：C。2，6-二磷酸果糖

解析：6-磷酸果糖激酶-1的变构激活剂有AMP、ADP、1，6-双磷酸果糖和2，6-二磷酸果糖（C对A错）。其中1，6-双磷酸果糖是6-磷酸果糖激酶-1的反应产物，这是一种产物对酶的正反馈作用。而2，6-二磷酸果糖是6-磷酸果糖激酶-1最强的别构激活剂，因此本题最佳答案是C。ATP（B错）和柠檬酸（E错）是它的别构抑制剂。GTP（D错）不参与6-磷酸果糖激酶-1的变构调节。